急性胰腺炎的典型症状是
A. 脐周阵发性疼痛，停止肛门排便和排气
B. 上腹部剧烈疼痛，向左上臂内侧放射
C. 上腹部烧灼样疼痛，进食后可缓解
D. 上腹部持续性剧烈疼痛，向腰背部放射
E. 阵发上腹部钻顶样疼痛，碾转体位

正确答案：D。上腹部持续性剧烈疼痛，向腰背部放射

解析：胰腺受交感神经和副交感神经双重支配，交感神经支配胰腺的感觉，副交感神经支配腺泡、胰岛和腺管的分泌。胰腺的感觉纤维经腹腔神经丛传入第5～9或第10胸髓节段。因此急性胰腺炎时，胰腺内部炎症、胰酶激活等刺激产生的疼痛感觉表现为上腹部持续性剧烈疼痛，向腰背部放射（D对）。脐周阵发性疼痛，停止排便和排气（A错）为机械性肠梗阻（P358）的典型症状。上腹部剧烈疼痛，向左上臂内侧放射（B错）为稳定性心绞痛（九版内科学P219）的疼痛特点之一。上腹部烧灼样疼痛，进食后可缓解（C错）为十二指肠溃疡的典型症状。阵发上腹部钻顶样疼痛，辗转体位（E错）为胆道蛔虫症（P447）的典型症状。